当前治疗慢性粒细胞白血病慢性期首选的化疗药物是
A. 马利兰
B. 羟基脲
C. 靛玉红
D. 美法仑
E. 高三尖杉酯碱

正确答案：B。羟基脲

解析：按八版内科学当前治疗慢性粒细胞白血病慢性期首选的化疗药物是分子靶向药物甲磺酸伊马替尼。羟基脲（B对）主要用于TKI和INF-α均不耐受的患者以及用于高白细胞淤滞时降白细胞处理；马利兰（A错）为一种烷化剂，现已较少使用；靛玉红（C错）、美法仑（D错）、高三尖杉酯碱（E错）均可用于慢性粒细胞白血病的治疗，但不是首选。本题无正确答案，但给出的参考答案为B。